下列关于环糊精包合物作的说法，正确的是
A. 环糊精包合物可减少药物的刺激性
B. 环糊精包合物可调节药物的释放度
C. 环糊精包合物可提高药物的稳定性
D. 环糊精包合物可增加药物的溶解度
E. 环糊精包合物可使药物具有靶向性

正确答案：A、B、C、D。环糊精包合物可减少药物的刺激性；环糊精包合物可调节药物的释放度；环糊精包合物可提高药物的稳定性；环糊精包合物可增加药物的溶解度

解析：本题考查的是环糊精包合物的作用。关于环糊精包合物作的说法，正确的是环糊精包合物可减少药物的刺激性（A对）、调节药物的释放度（B对）、提高药物的稳定性（C对）、增加药物的溶解度（D对）。环糊精包合技术系指将药物分子包藏于环糊精分子空穴结构内形成环糊精包合物的技术。环糊精包合物的作用：①提高药物的稳定性。②增加药物的溶解度。③减少药物的刺激性，掩盖不良臭味。④调节药物的释放速度。⑤使液体药物粉末化而便于制剂。环糊精包合物不具有使药物具有靶向性的作用（E错）。